甘油一酯合成甘油三酯途径中小肠黏膜细胞利用消化吸收的甘油一酯合成甘油三酯的催化酶是
A. 脂酰转移酶
B. 磷脂肪酸磷酸酶
C. 柠檬酸裂解酶
D. 敏感性脂肪酶
E. 同工酶

正确答案：A。脂酰转移酶

解析：甘油一酯途径：小肠黏膜细胞利用消化吸收的甘油一酯及脂肪酸再合成甘油三酯，合成反应由脂酰转移酶催化。掌握“脂质功能，消化吸收，及合成”知识点。